容易引发药物过敏性口炎的药物是
A. 解热镇痛药、安眠镇静药、磺胺类药、维生素
B. 解热镇痛药、抗生素类药、安眠类药、镇静类药
C. 解热镇痛药、安眠镇静药、磺胺类药、无机盐类药
D. 解热镇痛药、安眠镇静药、维生素、抗生素类药
E. 解热镇痛药、安眠镇静药、磺胺类药、复方氨基酸制剂

正确答案：B。解热镇痛药、抗生素类药、安眠类药、镇静类药

解析：超敏反应是引起药物过敏的主要原因。大多数药物和其代谢分解产物为半抗原，需与机体内大分子载体蛋白结合后才能成为全抗原。药物抗原通过和抗体结合成或致敏淋巴细胞而产生超敏反应。常见的有抗生素类；解热镇痛药；催眠与抗癫痫药等。掌握“血管神经性水肿”知识点。